女孩儿3岁，因发现双下肢畸形来诊。查体：T36.5℃，P100次/分，轻度肋缘外翻，双肺呼吸音清，未闻及干湿性啰音，心律齐，腹软，无压痛，双下肢呈O型，可见手足镯。骨骼X线检查示佝偻病，活期表现。实验室检查：血钙正常，血磷低，尿磷增加，血碱性磷酸增高，最可能的诊断是
A. 维生素D缺乏性佝偻病
B. 维生素D依赖性佝偻病
C. 肾小管酸中毒
D. 肾性佝偻病
E. 低血磷抗维生素D佝偻病

正确答案：E。低血磷抗维生素D佝偻病

解析：女孩儿3 岁（低血磷抗维生素D佝偻病多发生于1岁以后，2-3岁仍有活动性表现）。因发现双下肢畸形来诊。查体: T36. 5℃， P100 次/分。轻度肋缘外翻（符合低血磷抗维生素D佝偻病临床表现），双肺呼吸音清，闻及干湿性罗音，心律齐腹软，无压痛。双下肢呈O型。可见手足镯，骨骼X线检查示佝偻病。活动期表现。实验室检查:血钙正常，血磷低，尿磷增加，血碱性磷酸酶增高，最可能的诊断是低血磷抗维生素D佝偻病（E对）。